桡骨头半脱位最常见的处理方法是
A. 切开复位，内固定
B. 手法复位，石膏外固定
C. 手法复位，无须制动固定
D. 切开复位，外固定
E. 手法复位，三角巾悬吊

正确答案：C。手法复位，无须制动固定

解析：桡骨头半脱位多见于5岁以下的儿童，症状大多不严重，不用麻醉可直接手法复位，复位后不用固定，但不可再次暴力牵拉，以免复发（C对）。切开复位（AD错）主要用于关节内骨折、骨折端间有软组织嵌入及不稳定骨折等。手法复位，石膏固定（B错）既可用于肩、肘等大关节脱位的治疗也可用于部分骨折的治疗。手法复位，三角巾悬吊（E错）常用于肩关节脱位或者肘关节的治疗。